湿邪阻遏，气虚受阻的面色是
A. 黄而鲜明
B. 黄如烟熏
C. 面黄而垢
D. 淡黄消痩
E. 淡黄浮肿

正确答案：E。淡黄浮肿

解析：脾虚运化无力，气血生化不足，无以上荣于面，则面色发黄；湿邪内蕴、脾失运化，以致脾土之色外现而见面黄。脾失运化，水湿停于内，泛溢于肌肤，故面色浮肿，脾虚气血受困故面色淡黄（E对）。黄疸患者可见面目一身俱黄，湿热蕴结可导致患者黄而鲜明如橘皮色（A错），称为阳黄。寒湿困阻可导致患者黄而晦暗如烟熏（B错），称为阴黄。脾虚无力运化水湿，湿邪偏盛，湿邪上蒙头面，则面垢眵多，故面黄而垢（C错）。脾胃气虚，气血不足则面色黄而枯稿无光，见面黄消瘦（D错）。